成人天门冬氨酸氨基转移酶的正常范围小于
A. 20U/L
B. 30U/L
C. 40U/L
D. 50U/L
E. 60U/L

正确答案：C。40U/L

解析：本题考查的是肝功能检查中血清天门冬氨酸氨基转移酶的参考值。成人天门冬氨酸氨基转移酶的正常范围小于40U/L（C对）。血清天门冬氨酸氨基转移酶（AST）：AST同样是体内最重要的氨基转移酶之一，催化L-天门冬酸与α-酮戊二酸间氨基转移反应，旧称谷转氨酶（GPT）。AST同样主要存在于心肌、肝肾、骨骼肌、胰腺、脾、肺、红细胞等组织细胞中；同时也存在于正常人血浆、胆汁、脑脊液及唾液中。当富含AST的组织细胞受损时，细胞通透性增加，AST从细胞释放增加，进入血液后导致AST活力上升。（一）参考值：速率法：成人8～40U/L。（二）临床意义：AST升高常见于以下情况。1.急性心肌梗死（AMI）；2.肝脏疾病；3.其他疾病：进行性肌肉营养不良、皮肌炎、肺栓塞、肾炎、胸膜炎、急性胰腺炎、肌肉挫伤、坏疽、溶血性疾病。4.用药。